医师在执业活动中，人格尊严人身安全不受侵犯是
A. 医师的社会地位
B. 医师的执业条件
C. 医师的职责
D. 医师的权利
E. 医师的义务

正确答案：D。医师的权利

解析：医师在执业活动中，人格尊严人身安全不受侵犯是医师的权利（D对）。